男婴，5天。啼哭、哺乳困难，临床检查见患儿两颊黏膜、软腭充血，上有散在的色白如雪的柔软小斑点，针头大小，斑点稍用力可擦掉。该患儿可能患有的疾病是
A. 扁平苔藓
B. 疱疹样口疮
C. 雪口病
D. 天疱疮
E. 复发性阿弗他溃疡

正确答案：C。雪口病

解析：本题考查雪口病的诊断。该患者为新生儿，啼哭、哺乳困难，两颊黏膜、软腭充血，色白如雪的柔软小斑点，稍用力可擦掉。综合考虑该患儿可能患有的疾病是雪口病（C对）。急性假膜型念珠菌性口炎可发生于任何年龄，以新生儿最多见，又称为鹅口疮或雪口病。扁平苔藓（A错）的口腔表现为树枝状或网状的白色细纹，并有时出现白色斑点、斑片或斑块。疱疹样口疮（B错）多由疱疹病毒感染所致。常发生于严重感冒后不久，短期内口腔内出现大量散在的小溃疡。天疱疮（D错）是一类重症的皮肤病。特征为薄壁、易于破裂的大疱。复发性阿弗他溃疡（E错）以口腔黏膜各部位反复发作的溃疡为特征。以上均不符合本病例的临床表现，应诊断为雪口病。